某女，30岁，患鼻窦炎数日，症见鼻塞，流黄涕，头痛，尿黄。证属肺经风热及胆腑郁热，治当疏风散热，祛湿通窍，宜选用的成药是
A. 藿胆丸
B. 鼻炎康片
C. 辛芩颗粒
D. 千柏鼻炎片
E. 鼻渊舒口服液

正确答案：E。鼻渊舒口服液

解析：本题考查的是鼻渊舒口服液的功能。患鼻窦炎数日，症见鼻塞，流黄涕，头痛，尿黄。证属肺经风热及胆腑郁热，治当疏风散热，祛湿通窍，宜选用的成药是鼻渊舒口服液（E对）。鼻渊舒口服液：【功能】疏风清热，祛湿通窍。藿胆片（A错）：【功能】芳香化浊，清热通窍。鼻炎康片（B错）：【功能】清热解毒，宣肺通窍，消肿止痛。辛芩颗粒（C错）：【功能】益气固表，祛风通窍。千柏鼻炎片（D错）：【功能】清热解毒，活血祛风，宣肺通窍。